下列哪种偏倚只可能出现在队列研究中，而不会出现在病例对照研究中
A. 选择偏倚
B. 失访偏倚
C. 调查偏倚
D. 混杂偏倚
E. 信息偏倚

正确答案：B。失访偏倚